《中药品种保护条例》适用于我国生产制造的
A. 中药材
B. 中药人工制品
C. 天然药物的提取物及其制剂
D. 中药饮片
E. 中成药

正确答案：B、C、E。中药人工制品；天然药物的提取物及其制剂；中成药

解析：本题考查《中药品种保护条例》的适用范围。《中药品种保护条例》适用于中国境内生产制造的，包括中成药（E对）、天然药物的提取物及其制剂（C对）和中药人工制品（B对）。